正确的是
A. 右侧面部表情肌全部瘫痪
B. 左侧面部表情肌全部瘫痪
C. 左侧额纹消失
D. 右侧额纹消失
E. 两侧额纹不消失

正确答案：E。两侧额纹不消失

解析：面神经核上部管理面上部表情肌，受双侧皮质核束支配；面神经核下部管理面下部表情肌，仅受对侧皮质核束支配。因而左侧面神经核上瘫时，双侧面神经核上部仍可受右侧皮质核束支配，双侧面上部表情肌不出现瘫痪（AB错），故两侧额纹不消失（E对CD错）；因右侧面神经核下部仅受左侧皮质核束支配，故出现右侧面下部表情肌瘫痪。